中医认为代偿性月经的发病机理是
A. 冲任损伤，不能制约经血
B. 气虚失摄，血失所统
C. 冲任不固，气血运行失常
D. 热扰冲任，迫血妄行
E. 血热气逆，冲任失调

正确答案：E。血热气逆，冲任失调

解析：代偿性月经相类于中医的经行吐衄病。火热气逆，热伤经络为本病发病的主要机理，伴随月经周期性发作又与经期冲气偏盛和患者的体质有密切的关系，中医认为妇女经前或经期气血汇聚冲脉，血海盛实，冲气较盛，若患者平素情志不畅，肝经郁火，或肺肾阴虚，虚火上炎，或平素嗜食辛辣燥热，胃中伏火上攻，均可扰及冲脉，导致冲之得热，血必妄行，则血逆上溢而发为吐衄（E对）。崩漏的主要病机是冲任损伤，不能制约经血（A错）；晚期产后出血的主要发病机理为冲任不固，气血运行失常（C错）；胎漏的发病机理是热扰冲任，迫血妄行（D错）。